每日漱口使用的是
A. 0.02%NaF漱口液
B. 0.05%NaF漱口液
C. 0.2%NaF漱口液
D. 0.2%氯己定液
E. 0.12%氯己定液

正确答案：B。0.05%NaF漱口液

解析：本题考查氟的全身及局部应用。含氟漱口液的使用方法：0.05%NaF（230mg/L）溶液（B对）：每天使用一次。可交由患者在家使用，若给儿童使用，需在家长的监督下使用。